HCV的核酸类型是
A. 单股正链RNA
B. 单股负链RNA
C. 双股RNA
D. 单股DNA
E. 双股DNA

正确答案：A。单股正链RNA

解析：HCV基因组为单股正链RNA（+ssRNA），约长9.6kb，由9个基因区组成。掌握“丙型、丁型、戊型肝炎病毒”知识点。